凡属我国首创的物质，进行食品安全性毒理学评价时应进行的毒性试验为
A. 急性经口毒性试验、遗传毒性试验和28天经口毒性试验
B. 急性经口毒性试验、遗传毒性试验和90天经口毒性试验
C. 急性经口毒性试验、遗传毒性试验、90天经口毒性试验和致畸试验
D. 急性经口毒性试验、遗传毒性试验、90天经口毒性试验致畸试验、生殖发育性试验和毒物动力学试验
E. 急性经口毒性试验、遗传毒性试验、90天经口毒性试验、致畸试验、生殖发育性试验、毒物动力学试验、慢性毒性试验和致癌试验

正确答案：E。急性经口毒性试验、遗传毒性试验、90天经口毒性试验、致畸试验、生殖发育性试验、毒物动力学试验、慢性毒性试验和致癌试验

解析：本题考查不同受试物选择毒性试验的原则。凡属我国首创的物质，进行食品安全性毒理学评价时应进行的毒性试验为急性经口毒性试验、遗传毒性试验、90天经口毒性试验、致畸试验、生殖发育性试验、毒物动力学试验、慢性毒性试验和致癌试验（E对ABCD错）。